治疗流行性脑膜炎宜选用的药物是
A. 红霉素
B. 舒巴坦
C. 庆大霉素
D. 阿米卡星
E. 磺胺嘧啶

正确答案：E。磺胺嘧啶

解析：本题考查用于流行性脑膜炎的药物。治疗流行性脑膜炎宜选用的药物是磺胺嘧啶（E对）。磺胺嘧啶（SD）口服易吸收，但吸收较缓慢，血药浓度达峰时间为3～6小时，t1/2为8～13小时，是磺胺类中血浆蛋白结合率最低（38%～48%）和血脑屏障透过率最高的药物，在脑脊液中的浓度最高可达血药浓度的80%，因此对防治流行性脑脊髓膜炎有突出疗效，常为首选药。红霉素（A错）是治疗百日咳、军团菌病、空肠弯曲菌肠炎和支原体肺炎的首选药。舒巴坦（B错）与氨苄西林、头孢哌酮、哌拉西林、美洛西林等联合治疗敏感细菌所致的呼吸道、尿路、妇产科、腹腔内、皮肤软组织、眼耳鼻喉科和骨关节感染以及败血症、脑膜炎等。庆大霉素（C错）用于抗革兰阴性杆菌感染、铜绿假单胞菌感染、心内膜炎，口服可用于肠道感染或肠道手术前准备。阿米卡星（D错）临床主要用于对庆大霉素，卡那霉素耐药的革兰阴性杆菌如大肠杆菌、变形杆菌和绿脓杆菌引起的各种感染。